对于氧化锌丁香油类根管封闭剂的优点说法错误的是
A. 具有一定的稠度
B. 较好的封闭性能
C. 无明显收缩性
D. 对根尖周组织的刺激性较小
E. 无X线阻射性

正确答案：E。无X线阻射性

解析：氧化锌丁香油类根管封闭剂的优点包括：具有一定的稠度，能充填牙胶尖与根管壁之间的空隙：较好的封闭性能，无明显收缩性；材料硬固质对根尖周组织的刺激性较小；具有抗菌性。掌握“根管充填”知识点。